小建中合剂中桂枝的提取方法是
A. 双提法
B. 醇提法
C. 浸渍法
D. 渗漉法
E. 煎煮法

正确答案：A。双提法

解析：本题考查中药化学成分的提取。小建中合剂中桂枝的提取方法是双提法（A对）。小建中合剂【注解】本品制备时，桂枝经水蒸气蒸馏提取挥发油，另器保存；药渣及馏液与甘草、大枣加水煎煮2次，每次2小时，合并煎液，滤过，滤液浓缩至约560ml。白芍、生姜按渗漉法，用50%的乙醇渗漉。漉液浓缩后，与上液合并，静置、滤过，加入麦芽糖360g，再浓缩至近1000ml，加适量苯甲酸钠与桂枝挥发油搅匀，灌装，即得。双提法：本法是蒸馏法和水醇法的结合。中药复方中所含药物成分的性质各异，要同时保留药物的挥发性成分和非挥发性成分，选用双提法较为适宜。醇水法（B错）：本法依据的原理与水醇法相同，先以乙醇为溶剂提取，可显著减少某些醇中溶解度小的杂质如黏液质、淀粉、蛋白质等成分的提出，有利于提取液中相关成分的进一步纯化与精制。浸渍法（C错）：是在常温或温热（60℃～80℃）条件下用适当的溶剂浸渍药材以溶出其中有效成分的方法。本法适用于有效成分遇热不稳定的或含大量淀粉、树胶、果胶、黏液质的中药的提取。但本法出膏率低，需要特别注意的是当水为溶剂时，其提取液易于发霉变质，需注意加入适当的防腐剂。渗漉法（D错）：是不断向粉碎的中药材中添加新鲜浸出溶剂，使其渗过药材，从渗漉筒下端出口流出浸出液的一种方法。但该法消耗溶剂量大、费时长，操作比较麻烦。煎煮法（E错）：是中药材加入水浸泡后加热煮沸，将有效成分提取出来的方法。此法简便，但含挥发性成分或有效成分遇热易分解的中药材不宜用此法。